评价居室空气清洁程度的指标不包括
A. 二氧化碳
B. 微生物
C. 空气中重、轻离子比值
D. 烟尘
E. 有害气体

正确答案：C。空气中重、轻离子比值

解析：本题考查评价居室空气清洁程度的指标。空气清洁程度是指空气中的有害物质的含量，以及空气的洁净度、细菌数量等指标。空气清洁程度的评价可用二氧化碳（A对）、微生物（B对）、烟尘（D对）、有害气体（E对）。空气中重、轻离子比值（C错，为本题正确答案）是评价大气清洁程度的指标。